能溶于酸水溶液并可与碘化铋钾生成黄色至橘红色沉淀的是
A. 呋喃香豆素
B. 吡喃香豆素
C. 黄酮
D. 生物碱
E. 木脂素

正确答案：D。生物碱

解析：本题考查的是生物碱沉淀试剂。能溶于酸水溶液并可与碘化铋钾生成黄色至橘红色沉淀的是生物碱（D对）。大多数生物碱在酸水或稀醇中与某些试剂反应生成难溶于水的络合物或复盐，这一反应称为生物碱沉淀反应，这些试剂称为生物碱沉淀试剂。常用的生物碱沉淀试剂有碘化铋钾试剂、碘化汞钾试剂、碘-碘化钾试剂、硅钨酸试剂、饱和苦味酸试剂、雷氏铵盐试剂等。生物碱与碘化铋钾试剂生成黄色至橘红色无定形沉淀。呋喃香豆素（A错）、吡喃香豆素（B错）属于香豆素类化合物。香豆素的显色反应：（1）异羟肟酸铁反应；（2）三氯化铁反应；（3）Gibb's反应；（4）Emerson反应。黄酮（C错）的显色反应：黄酮类化合物的显色反应多与分子中的酚羟基及γ-吡喃酮环有关。1.还原试验：（1）盐酸-镁粉（或锌粉）反应；（2）四氢硼钠（钾）反应；2.金属盐类试剂的络合反应：（1）铝盐；（2）铅盐；（3）锆盐；（4）镁盐；（5）氯化锶；（6）三氯化铁；3.硼酸显色反应；4.碱性试剂显色反应。木脂素（E错）分子中常用的官能团为醇羟基、酚羟基、甲氧基、亚甲二氧基、羧基和内酯环，因此它也具有这些官能团所具有的化学性质。如Labat反应等。